对反复发作的顽固性哮喘或哮喘持续状态疗效较好的药物是
A. 哌替啶
B. 异丙肾上腺素
C. 色甘酸钠
D. 氯化铵
E. 二丙酸倍氯米松

正确答案：E。二丙酸倍氯米松

解析：二丙酸倍氯米松（E对）属于糖皮质激素类抗炎平喘药，进入靶细胞内与受体结合成复合物，进入细胞核，影响炎症相关基因的转录，抑制哮喘时炎症反应的多个环节发挥平喘作用，对反复发作的顽固性哮喘或哮喘持续状态疗效较好。哌替啶（A错）是目前临床应用最多的人工合成的镇痛药，同时还具有明显镇静作用，缓解患者的焦虑情绪。异丙肾上腺素（B错）属于β受体激动剂类支气管扩张药，可松弛支气管平滑肌，抑制组胺释放，临床主要用于支气管哮喘以及伴有支气管痉挛的呼吸道疾病。色甘酸钠（C错）属于抗过敏平喘药，可稳定肥大细胞膜，抑制肥大细胞释放过敏介质，临床必需采用粉剂雾化方式吸入给药，且只用于预防哮喘发作。氯化铵（D错）属于刺激性祛痰药，可使腺体分泌增加，痰液变稀，易于咳出，适用于干咳及痰液不易咳出，也用于酸化尿液。